男，48岁。尿少、双下肢水肿半年，低热、消瘦2个月。慢性乙肝病史20年。最重要的实验室检查是
A. 血γ-谷氨酰转肽酶
B. 血白蛋白
C. 血胆红素
D. 血甲胎蛋白
E. 血丙氨酸氨基转移酶

正确答案：D。血甲胎蛋白

解析：中年男性患者，有20年慢性乙肝病史（肝炎发展的三部曲：肝炎→肝硬化→肝癌，提示有发展为肝癌的可能），尿少双下肢水肿半年（肝功能减退的表现），低热、消瘦2个月（肝癌的全身性表现），综合病人的病史、临床表现，考虑原发性肝癌的可能性大。甲胎蛋白（D对）是诊断肝细胞癌特异性的标志物，阳性率约为70%。血γ-谷氨酰转肽酶（A错）在肝脏中广泛分布于肝细胞的毛细胆管一侧和整个胆管系统，当肝内合成亢进或胆汁排出受阻时，血清中γ-谷氨酰转肽酶增高。血白蛋白（B错）、血胆红素（C错）、血丙氨酸氨基转移酶（E错）的测定对肝功能有一定的反应，有助于了解病情，不能明确诊断。